回忆偏倚与报告偏倚的区别在于
A. 回忆偏倚是由于调查的事件发生率较低，未留下深刻的印象，研究对象不能很好的回忆起来，而报告偏倚是因为调查事件发生很久，记忆不清，没有报告
B. 回忆偏倚在病例对照研究中最常见，报告偏倚在队列研究中最常见
C. 回忆偏倚在病例对照研究中最常见，报告偏倚在干预研究中最常见
D. 回忆偏倚是研究对象不能准确、完整地回忆以往发生的事情和经历时所产生，报告偏倚是研究对象有意扩大或缩小某些信息造成的偏倚

正确答案：D。回忆偏倚是研究对象不能准确、完整地回忆以往发生的事情和经历时所产生，报告偏倚是研究对象有意扩大或缩小某些信息造成的偏倚

解析：本题考查回忆偏倚与报告偏倚的区别。回忆偏倚与报告偏倚的区别在于：回忆偏倚是研究对象不能准确、完整地回忆以往发生的事情和经历时所产生，报告偏倚是研究对象有意扩大或缩小某些信息造成的偏倚（D对ABC错）。